骨痂形成的时间
A. 4~8小时
B. 24~72小时
C. 1~2周
D. 2周后
E. 4周后

正确答案：C。1~2周

解析：本题考查骨折的愈合。骨痂形成的时间为1～2周（C对）。骨折后1～2周，机化的血块被纤维血管组织所替代，再沉积胶原纤维和钙盐，通过成骨细胞和多种内源性生长因子的作用，逐渐产生骨样组织和新骨，形成骨痂。